右输尿管上段结石0.4cm×0.3cm，应选择的治疗方法是
A. 输尿管软镜激光碎石
B. 体外冲击波碎石
C. 药物排石
D. 经输尿管镜碎石
E. 经皮肾镜碎石

正确答案：C。药物排石

解析：泌尿系统结石的治疗方法主要取决于结石大小和部位。其中输尿管结石的治疗原则是：直径＜0.6cm的结石，可行药物治疗；0.6cm≤直径≤2cm的结石，输尿管上段行体外冲击波碎石（ESWL），输尿管中下段行输尿管镜取石术（URL）；＞2cm的结石，行腹腔镜输尿管取石（LUL）。该患者结石0.4cm×0.3cm，位于输尿管上段，应选择的治疗方法是药物排石（C对）。输尿管软镜激光碎石（A错）主要用于肾结石（＜2cm）的治疗。经皮肾镜碎石（E错）主要用于肾结石（＞2cm）的治疗。